男性，55岁，下颌876│34缺失，可摘局部义齿在5│上采用RPI卡环。当义齿游离端受到咬合压力时，RPI卡环I型杆的移动方向是
A. 颊向
B. 舌向
C. （牙合）向
D. 龈向
E. 远中向

正确答案：D。龈向

解析：游离缺失的末端基牙上设计RPI卡环时，（牙合）支托位于基牙近中（牙合）边缘嵴。义齿游离端受咬合压力时，义齿以近中（牙合）支托为支点。由于RPI卡环的邻面板和I型杆与义齿游离鞍基均位于（牙合）支托支点的远中，因此I型杆会与游离鞍基一起向下（龈向）移动。掌握“局部义齿固位体”知识点。